干髓剂中不含何种成份
A. 地卡因
B. 多聚甲醛
C. 碘甘油
D. 麝香草酚
E. 羊毛脂

正确答案：C。碘甘油

解析：本题考查干髓剂。碘甘油（C错，为本题的正案确答）是消毒防腐剂，适应证为用于口腔黏膜溃疡、牙龈炎及冠周炎，不是干髓剂的主要成分。干髓剂是使坏死的牙神经干尸化后长期保留在牙齿内的制剂。多聚甲醛（B对）作用于牙髓，使血管壁平滑肌麻痹，血管扩张，形成血栓，引起血运障碍而使牙髓坏死，其凝固蛋白的作用，能使坏死牙髓组织无菌性干化，是常用干髓剂的主要成分。另外还含有麝香草酚（D对）具有杀菌作用且毒性低。氧化锌具有收敛性和一定的杀菌力，地卡因（A对）具有麻醉神经的作用，减少疼痛，羊毛脂（E对）具有黏稠性可包裹干髓剂的各种成分，使其成膏状。